流行性出血热引起急性肾功能不全的最主要原因是
A. 肾小球滤过率下降和缺血性肾小管变性、坏死
B. 肾小球微血栓形成和缺血性坏死
C. 肾小管中管型形成
D. 肾间质水肿压迫肾小管
E. 肾素、血管紧张素的激活

正确答案：A。肾小球滤过率下降和缺血性肾小管变性、坏死

解析：流行性出血热引起急性肾功能衰竭的主要原因是肾小球的率过滤下降和缺血性肾小管变性、坏死（A对）；主要原因包括肾血流量不足致肾小球滤过率急剧下降；免疫复合物沉积于肾小管和肾小球基底膜导致免疫损伤；肾间质水肿和出血，压迫肾小管致尿量减少；肾实质缺血性坏死；肾素、血管紧张素Ⅱ激活致肾小球率过滤降低；肾小管管腔被蛋白、管型阻塞致尿液排出受阻。肾小管中管型形成（C错）、肾间质水肿压迫肾小管（D错）导致尿量减少是肾小管变性坏死的原因之一；肾素、血管紧张素的激活（E错）是导致肾小球率过滤降低的原因之一。